血浆蛋白浓度降低所致水肿的原因是
A. 血浆胶体渗透压降低
B. 动脉血压升高
C. 毛细血管壁通透性增加
D. 淋巴回流量减少
E. 组织液静水压升高

正确答案：A。血浆胶体渗透压降低

解析：水肿是指组织间隙内的体液增多，组织液的生成是由血液中的液体滤过到组织间隙的过程，液体通过毛细血管壁移动的方向，由毛细血管血压、组织液净水压、血浆胶体渗透压和组织胶体渗透压4个因素综合作用决定的，其中，血浆胶体渗透压该是促使液体由血管外回流至血管内的力量。A：血浆胶体渗透压主要由血浆白蛋白维持，当血浆白蛋白合成减少或大量丧失时，血浆胶体渗透压下降，平均实际滤过压相应增大，组织液的生成增加（A对）。B：毛细血管血压升高能导致组织液生成增多和水肿.动脉血压增高对组织液的生成影响不大。C：毛细血管壁通透性增加导致蛋白漏出到组织间隙，使组织间液胶体渗透压增高，组织间隙生成增加。D：淋巴回流受阻，在受阻部位远端的组织间隙中组织液积聚而出现水肿。E：组织液静水压增高会导致组织液生成减少。